可在尿液中析出结晶而阻塞肾小管或集合管，导致梗阻性急性肾功能衰竭的药物有
A. 甲氨蝶呤
B. 磺胺嘧啶
C. 胰岛素
D. 阿昔洛韦
E. 布洛芬

正确答案：A、B、D。甲氨蝶呤；磺胺嘧啶；阿昔洛韦

解析：本题考查药物对机体的作用。可在尿液中析出结晶而阻塞肾小管或集合管，导致梗阻性急性肾功能衰竭的药物有甲氨蝶呤（A对）、磺胺嘧啶（B对）、阿昔洛韦（D对）等；胰岛素（C错）可以引起低血糖；布洛芬（E错）可引起胃肠道反应。